患者，女，52岁。颈前结喉右侧肿物3cm×3cm×2cm，质地较硬，表面不光，不能随吞咽而上下移动，同时伴有局部疼痛，音哑，临床考虑为石瘿。行同位素131I扫描，其结果多是
A. 温结节
B. 热结节
C. 冷结节
D. 无改变
E. 中性结节

正确答案：C。冷结节

解析：该患者52岁，女性，结喉部有肿块，质地坚硬，高低不平，不随吞咽移动，可诊断为石瘿，用131碘扫描显示为冷结节（C对）。肉瘿同位素131碘扫描多显示温结节（A错），囊肿多为凉结节，伴有甲亢者多为热结节（B错）。